以下哪项不是艾滋病的预防措施
A. 避免性关系紊乱
B. 严格检疫，防止传入
C. 加强高危人群的监视
D. 避免与艾滋病病人的日常接触
E. 严格筛查供血人员和血液制品

正确答案：D。避免与艾滋病病人的日常接触

解析：本题考查艾滋病的预防措施。避免与艾滋病病人的日常接触（D错，为本题的正确答案）不是艾滋病的预防措施。艾滋病的预防措施：1.控制传染源严格检疫：（1）防止传入（B对）。（2）加强高危人群的监视（C对）。（3）患者及无症状携带者应隔离，其血液、体液与分泌物进行消毒。2.切断传播途径：（1）严格筛查供血人员和血液制品（E对）。（2）避免性关系紊乱（A对）。（3）严禁注射毒品，打击吸毒贩毒。（4）焚烧或消毒处理患者所用物品。在保证不与艾滋病人的体液接触的前提下，可以与艾滋病病人进行日常接触。3.保护易感人群：（1）艾滋病患者及HIV感染者，不提倡结婚与妊娠。（2）孕妇不要护理艾滋病患者。